中、晚餐前血糖控制较满意。此时何种措施为最佳选择
A. 中、晚餐前加用中效胰岛素
B. 睡前增加1次短效胰岛素
C. 晚餐减量
D. 睡前加用口服二甲双胍
E. 加强午夜及凌晨血糖监测，然后再调整胰岛素用量

正确答案：E。加强午夜及凌晨血糖监测，然后再调整胰岛素用量

解析：该患者多饮、多尿、纳差伴体重下降半年（糖尿病主要临床表现），血糖19.2 mmol/L（≥11.1 mmol/L），综合该患者的糖尿病症状加随机血糖可诊断为糖尿病。该患者血糖升高明显的症状符合胰岛素的适应症，由于该患者中、晚餐前血糖控制较满意，中晚餐前不需要使用胰岛素（A错）。该患者在治疗1个月后空腹血糖14mmol/L（空腹血糖的控制目标为3.9～7.7），应该调整胰岛素用量，夜间和凌晨患者血糖控制不清楚，应该加强午夜及凌晨血糖监测，然后调整胰岛素用量（E对）。睡前增加1次短效胰岛素（B错）、晚餐减量（C错）、睡前加用口服二甲双胍（D错）一般不用来调整夜间血糖水平。